幽门梗阻可出现的是
A. 麦氏点压痛阳性
B. 墨菲征阳性
C. 液波震颤阳性
D. 振水音阳性
E. 移动性浊音阳性

正确答案：D。振水音阳性

解析：幽门梗阻可出现的是振水音阳性（D对）。麦氏点压痛阳性见于急性阑尾炎（A错）。墨菲征阳性见于急性胆囊炎（B错）。液波震颤阳性见于大量腹水（C错）。移动性浊音阳性见于腹腔积液（E错）。